上颌突与侧鼻突未联合则形成
A. 唇裂
B. 横面裂
C. 斜面裂
D. 侧鼻裂
E. 下颌裂

正确答案：C。斜面裂

解析：上下颌突未联合或部分联合，发生横面裂，如上颌突与侧鼻突未联合则形成斜面裂。裂隙由上唇沿着鼻翼基部至眼睑下缘。掌握“面部的发育”知识点。